食物中毒暴发调查时，应选用的指标是
A. 患病率
B. 发病密度
C. 罹患率
D. 感染率
E. 续发率

正确答案：C。罹患率

解析：本题考查罹患率的用途。罹患率（C对ABDE错）是测量某人群某病新病例发生频率的指标，通常指在某一局限范围短时间内的发病率。在食物中毒、职业中毒或传染病的暴发及流行中，经常使用罹患率这一指标。